对过敏性结膜炎者宜选用的滴眼剂是
A. 色甘酸钠
B. 碘苷
C. 维生素B₂
D. 磺胺醋酰钠
E. 硫酸锌

正确答案：A。色甘酸钠

解析：本题考查结膜炎用药。色甘酸钠滴眼液（A对）可用于治疗过敏性结膜炎，其不仅可抑制炎症过程的早期表现，还能降低毛细血管壁和毛细血管膜的通透性，减少炎症的渗出。碘苷（B错）可用于治疗流行性结膜炎，浓度为1%，一次1～2滴，每间隔2h给予1次。维生素B₂（C错）可用于治疗维生素B₂缺乏引起的结膜炎。磺胺醋酰钠（D错）可用于治疗急性卡他性结膜炎。硫酸锌（E错）可用于治疗由环境刺激所致的非细菌性结膜炎。